男，56岁。反酸烧心5年。胃镜检查：食管下段黏膜多发条形破损，相互融合。该患者首选的治疗药物是
A. 奥美拉唑
B. 法莫替丁
C. 硫糖铝
D. 枸橼酸铋钾
E. 铝碳酸镁

正确答案：A。奥美拉唑

解析：该患者反酸烧心5年，提示胃食管反流病，因为烧心和反流是胃食管反流的典型症状。胃镜检查食管下段黏膜多发条形破损，相互融合，提示患者为反流性食管炎的C级或D级，为重症食管炎。奥美拉唑属于抑酸药中的PPI，PPI适用于症状重的严重食管炎的患者，因此该患者首选的药物是奥美拉唑（A对）。法莫替丁属于H2RA，适用于轻、中症患者（B错）。枸橼酸铋钾为胃粘膜保护剂，主要为治疗消化性溃疡的二线药物（D错）。硫糖铝（C错）、铝碳酸镁（E错）为弱碱性抗酸药，仅用于症状轻、间歇发作的患者临时缓解症状（E错）。